具有利尿降压作用的药物
A. 可乐定
B. 美加明
C. 利血平
D. 卡托普利
E. 氢氯噻嗪

正确答案：E。氢氯噻嗪

解析：本题考查氢氯噻嗪。具有利尿降压作用的药物是氢氯噻嗪（E对）。氢氯噻嗪为中效能利尿药，是一类口服利尿药和降压药，其药理作用包括利尿作用、抗利尿作用和降压作用。可乐定（A错）为中枢性降压药。美加明（B错）为神经节阻断药。利血平（C错）为去甲肾上腺素能神经末梢阻滞药。卡托普利（D错）为血管紧张素Ⅰ转化酶抑制剂。